既能宣通鼻窍，又能发散风寒，祛风湿，止痛的药物是
A. 独活
B. 羌活
C. 防风
D. 苍耳子
E. 辛夷

正确答案：D。苍耳子

解析：苍耳子性味辛苦温，有毒，归肺经，其功效为散风寒，通鼻窍，祛风湿，止痛（D对）。独活的功效为祛风除湿，通痹止痛，解表（A错）。羌活的功效为解表散寒，祛风除湿，止痛（B错）。防风的功效为祛风解表，胜湿止痛，止痉（C错）。辛夷的功效为散风寒，通鼻窍（E错）。